治疗劳疟，应首选
A. 柴胡截疟饮
B. 白虎加桂枝汤
C. 柴胡桂枝干姜汤
D. 加味不换金正气散
E. 何人饮

正确答案：E。何人饮

解析：劳疟是由于疟邪久留，使气血耗伤而得，治疗应益气养血，扶正祛邪，选补气养血的何人饮（E对）。柴胡截疟饮，其功能为袪邪截疟，适用于治疗正疟（A错）。白虎加桂枝汤，其功用为清热袪邪，可用于治疗温疟(B错)。柴胡桂枝干姜汤，其功用为和解表里，温阳达邪，与截疟七宝饮合用，可用于治疗寒疟（C错）。加味不换金正气散，其功用为发出风毒，适用于痈疽，寒热往来，或内挟风邪，或内气虚馁（D错）。